一患者戴用全口义齿一周，主诉左侧后牙经常咬腮，无其他不适。最可能的原因是
A. 左侧后牙覆盖过大
B. 左侧后牙覆盖过小
C. 左侧后牙工作侧（牙合）干扰
D. 左侧后牙平衡侧（牙合）干扰
E. 右侧后牙平衡侧（牙合）干扰

正确答案：B。左侧后牙覆盖过小

解析：本题考查戴用义齿后可能出现的问题及原因。正常覆盖的生理意义是保护颊黏膜和舌。左侧后牙经常咬腮，最可能的原因是左侧后牙覆盖过小（B对），失去了正常覆盖对颊侧黏膜的保护作用，咬合时颊肌进入上下牙尖之间。左侧后牙覆盖过大（A错），上颌后牙的颊侧会将颊侧黏膜支开，反而不会出现咬腮现象。左侧后牙工作侧（牙合）干扰（C错），会影响工作侧同名牙尖发生咬合，不会出现咬腮现象。左侧为平衡侧时（D错），右侧为工作侧，下颌偏向工作侧，工作侧同名牙尖相对，平衡侧异名牙尖相对，左侧不发生嚼碎功能，不会咬腮。右侧后牙平衡侧（牙合）干扰（E错），使左侧工作侧不能发生稳定的咬合接触，不会发生咬腮。